患者小便短数，灼热刺痛，色黄赤舌苔黄腻，脉濡数。治疗应选用
A. 大蓟
B. 地榆
C. 槐花
D. 白茅根
E. 侧柏叶

正确答案：D。白茅根

解析：小便短数，灼热刺痛，尿色黄赤舌苔黄腻，脉数，治以清热利尿，而达利水消肿，利尿通淋之效。白茅根具有凉血止血，清热利尿，清肺胃热的功效（D对）。大蓟具有凉血止血，散瘀解毒消痈的功效，主治血热妄行之诸出血证，没有清热利尿的功效（A错）。地榆具有凉血止血，解毒敛疮的功效，为水火烫伤之要药，没有清热利尿的功效（B错）。槐花具有凉血止血，清肝泻火的功效，对下部血热所致的痔血、便血最为适宜，没有清热利尿的功效（C错）。侧柏叶具有凉血止血，化痰止咳的功效，长于清肺热，没有利尿的功效（E错）。